性平，善疏肝理气的药是
A. 木香
B. 乌药
C. 沉香
D. 香附
E. 青皮

正确答案：D。香附

解析：本题考查香附的性味归经和性能特点。性平，善疏肝理气的药是香附（D对）。香附【性味归经】辛、微苦、微甘，平。归肝、三焦经。【性能特点】本品辛香行散，微苦略降，微甘能和，平而不偏。入肝、三焦经，善疏肝理气而止痛，为疏肝理气之佳品，被李时珍誉为“气病之总司，女科之主帅”。肝气舒畅，气血和顺，则月经自调，疼痛可除，故又为调经止痛之要药。木香（A错）【性味归经】辛、苦，温。归脾、胃、大肠、三焦、胆经。【性能特点】本品辛香温通，苦燥而降，可升可降。主入脾、胃经与大肠经，兼入三焦经与胆经。生用专于行散，能理气调中而止痛，消食、开胃、健脾。煨用行中有止，能实肠止泻。通理三焦，尤善行肠胃气滞，兼健脾消食，为行气调中止痛之要药，肠胃气滞有寒或兼食积、湿滞者用之最宜。乌药（B错）【性味归经】辛，温。归肺、脾、肾、膀胱经。【性能特点】本品辛温香散，上入肺经，中入脾经，下达肾经与膀胱经。善行气、散寒、止痛，治三焦寒凝气滞诸痛，为顺气散寒止痛之佳品。又能温肾、散膀胱冷气，治阳虚遗尿、尿频。沉香（C错）【性味归经】辛、苦，温。归脾、胃、肾经。【性能特点】本品辛香行散温通，味苦质重下行。入脾、胃经，既行气温中而止痛，又降胃气而止呕；入肾经，善温肾纳气平喘。集理气、降逆、纳气于一身，且温而不燥、行而不泄，无破气之害，故为理气良药。青皮（E错）【性味归经】苦、辛，温。归肝、胆、胃经。【性能特点】本品苦降下行，辛温行散，药力颇强，入肝、胆、胃经。既善疏肝破气，治肝郁胁痛、乳房疾患、寒疝腹痛；又善散结消滞，治癥瘕积聚、久疟癖块及食积腹痛。